对某药产生耐受性后，对另一药的敏感性亦降低
A. 交叉耐受性
B. 不良反应
C. 耐受性
D. 抗药性
E. 躯体依赖性

正确答案：A。交叉耐受性

解析：本题考查交叉耐受性。对某药产生耐受性后，对另一药的敏感性亦降低的是交叉耐受性（A对）。交叉耐受性是指人体对某药产生耐受性后，亦可能表现出对其他化学结构类似或作用机制类似的同类药物敏感性降低。药物不良反应（B错）是指不符合用药目的并给患者带来不适或痛苦的反应。耐受性（C错）是指在连续用药过程中，有的药物的药效会逐渐减弱，需加大剂量才能显效的现象。抗药性（D错）一般指耐药性，系指在化学治疗中，病原体或肿瘤细胞对化疗药物的敏感性降低的现象。躯体依赖性（E错）是指中枢神经系统对长期使用的药物所产生的一种身体适应状态；一旦停药，将发生一系列生理功能紊乱，称为戒断综合征。